《中华人民共和国刑法》规定，对伪造、变造、买卖国家机关的公文、证件、印章的处罚是
A. 处三年以下有期徒刑、拘役、管制或者剥夺政治权利
B. 处三年以下有期徒刑、拘役、管制或者剥夺政治权利，并处或单处罚金
C. 处十年以上有期徒刑
D. 处无期徒刑
E. 处死刑

正确答案：A。处三年以下有期徒刑、拘役、管制或者剥夺政治权利